肾蒂中位于最前方的结构是
A. 肾盂
B. 肾静脉
C. 肾动脉
D. 肾乳头
E. 肾柱

正确答案：B。肾静脉

解析：肾蒂中位于最前方的结构是肾静脉（B对）。